盐酸肾上腺素注射液含量测定的条件：用十八烷基硅烷键合硅胶为填充剂，以0.14%庚烷磺酸钠溶液-甲醇（65：35）为流动相，检测波长为280nm。根据上述方法，以下叙述正确的有
A. 上述方法为高效液相色谱法
B. 固定相为硅胶
C. 庚烷磺酸钠为离子对试剂
D. 使用紫外检测器
E. 使用氢火焰离子化检测器

正确答案：A、C、D。上述方法为高效液相色谱法；庚烷磺酸钠为离子对试剂；使用紫外检测器